砂炒马钱子能降低毒性，保留生物活性的原因有
A. 士的宁含量降低
B. 马钱子碱含量降低
C. 异士的宁含量增加
D. 异马钱子碱含量增加
E. 总生物碱含量增加

正确答案：A、B、C、D。士的宁含量降低；马钱子碱含量降低；异士的宁含量增加；异马钱子碱含量增加

解析：本题考查马钱子的炮制作用。砂炒马钱子能降低毒性，保留生物活性的原因有士的宁含量降低（A对）、马钱子碱含量降低（B对）、异士的宁含量增加（C对 ）、异马钱子碱含量增加（D对）。马钱子【炮制作用】马钱子主含生物碱，其中以番木鳖碱（即士的宁）和马钱子碱为多。士的宁和马钱子碱是马钱子中的有效成分和毒性成分。马钱子炮制后，圭的宁、马钱子碱含量均有不同程度下降，但士的宁下降较少，马钱子碱下降明显。马钱子所含的士的宁等生物碱在加热条件下可转变为异士的宁或其氮氧化物等。马钱子有大毒，毒性成分为马钱子碱，经砂烫炮制后士的宁和马钱子碱的含量显著减少，马钱子碱转化成异型结构和氮氧化合物，毒性下降。炮制后马钱子增加了异马钱子碱、2-羟基-3-甲氧基士的宁、异马钱子氮氧化物、异士的宁氮氧化物4种生物碱，其生物碱的种类增加了，但其总生物碱的含量下降甚微（E错）。通过炮制既降低其毒性，又减少了内在成分的损失。